关于瞳孔大小的描述，正确的是
A. 随眼压的高低而变化
B. 随光线的强弱而变化
C. 取决于睫状肌的舒缩状况
D. 取决于房水的通畅与否
E. 取决于虹膜内色素的多少

正确答案：B。随光线的强弱而变化

解析：瞳孔大小随光线的强弱而变化（B对），或视物距离的远近而变化。